显微鉴别可见不规则分枝状石细胞和油细胞的药材是
A. 肉桂
B. 杜仲
C. 黄柏
D. 厚朴
E. 秦皮

正确答案：D。厚朴

解析：本题考查的是厚朴的显微鉴别。显微鉴别可见不规则分枝状石细胞和油细胞的药材是厚朴（D对）。厚朴：【显微鉴别】粉末厚朴、姜厚朴石细胞类方形、椭圆形或不规则分枝状，直径11～65μm，壁厚，有的可见层纹。油细胞椭圆形或类圆形，含黄棕色油状物。纤维甚多，壁甚厚，有的呈波浪形或一边呈锯齿状，木化，孔沟不明显。肉桂（A错）：【显微鉴别】粉末纤维大多单个散在，长梭形，直径约至50μm，壁厚，木化，纹孔不明显。石细胞类圆形或类方形，壁厚，有的一面菲薄，直径32～88μm。油细胞类圆形或长圆形。黄柏（C错）：【显微鉴别】粉末黄柏、盐黄柏、黄柏炭纤维鲜黄色，常成束周围细胞含草酸钙方晶，形成晶纤维，含晶细胞壁木化增厚。石细胞鲜黄色，类圆形、纺锤形或呈分枝状，壁厚，层纹明显。草酸钙方晶众多。杜仲（B错）与秦皮（E错）的显微鉴别，2022年考试指南未明确说明。